恶性黑色素瘤的临床及病理特征叙述中，不正确的是
A. 青春期前很少发生恶性黑色素瘤
B. 早期表现绝大多数为皮肤痣及黏膜黑斑
C. 常发生广泛转移，约70%早期转移至区域性淋巴结
D. 靠术前活检明确诊断
E. 发生恶变时，则迅速长大，色素增多

正确答案：D。靠术前活检明确诊断

解析：恶性黑色素瘤主要根据色素表现及临床症状，不宜行活组织检查，即使是转移性淋巴结亦不应做吸取组织检查，因活检可促使其加速生长，并使肿瘤播散发生远处转移。对无色素性黑色素瘤则临床诊断常有困难，有时只能在病理检查后，才能确诊。掌握“恶性黑色素瘤”知识点。